总是与乙型肝炎同时发生或是重叠发生的是
A. 甲型肝炎
B. 乙型肝炎
C. 丙型肝炎
D. 丁型肝炎
E. 戊型肝炎

正确答案：D。丁型肝炎

解析：本题考查协同感染和重叠感染。总是与乙型肝炎同时发生或是重叠发生的是丁型肝炎（D对ABCE错）。协同感染是指同时感染HBV和HDV。重叠感染是指HBsAg携带者或慢性乙肝病人在原有HBV感染的基础上，又感染了HDV。